互联网对医疗卫生事业发展的影响可概括为4C，不包括
A. content
B. connection
C. communication
D. commerce
E. care

正确答案：C。communication

解析：本题考查互联网对医疗卫生事业发展的影响中的4C。互联网对医疗卫生事业发展的影响可概括为4C，包括内容（content）（A对）、连接（connection）（B对）、商务（commerce）（D对）、医疗保健（care）（E对）。4C不包括communication（C错，为本题正确答案）。